下列属于医学心理学的基本观点的是
A. 心身统一的观点
B. 心理护理的观点
C. 护理与预防观点
D. 养生保健的观点
E. 以上说法均正确

正确答案：A。心身统一的观点

解析：本题考查医学心理学概述、任务与观点。医学心理学的基本观点：心身统一的观点（A对）；社会对个体影响的观点；认知评价的观点；主动适应与调节的观点；情绪因素作用的观点；个性特征作用的观点。